可引起视物模糊、耳鸣、复视的非甾体抗炎药是
A. 卡马西平
B. 利培酮
C. 氯苯那敏
D. 吲哚美辛
E. 对乙酰氨基酚

正确答案：D。吲哚美辛

解析：本题考查驾驶员用药。可引起视物模糊、耳鸣、复视的非甾体抗炎药是吲哚美辛（D对）。非甾体抗炎药吲哚美辛可出现视力模糊、耳鸣、复视。抗癫痫药卡马西平（A错）在发挥抗癫痫作用的同时，可引起视力模糊、复视或眩晕，使驾驶员看路面或视物出现重影。抗精神病药利培酮（B错）服后偶见头晕、视力模糊、注意力下降等反应。氯苯那敏（C错）为抗组胺药，可引起眩晕、头痛、倦怠、嗜睡、乏力等反应。